对于切除阑尾的术后病人，宜采取的医患模式是
A. 主动-被动型
B. 被动-主动型
C. 指导-合作型
D. 共同参与型
E. 合作-指导型

正确答案：C。指导-合作型

解析：医患关系分为三种类型：主动-被动型、指导-合作型、共同参与型（BE错）。指导-合作型（C对）是指在医疗活动中，医患双方具有一定的主动性，但仍以医务人员为主，适合于急性感染期病人（如切除阑尾的术后病人）。主动-被动型（A错）指医师主动命令，病人被动服从，适合难以表述自己主观意见的病人，如麻醉、严重外伤昏迷的病人等。共同参与型（D错）指医患双方共同制定并实施诊断方案，适合慢性疾病病人和心理疾病病人。